《伤寒论》中“少阴病，下利清谷，里寒外热，手足厥逆，脉微欲绝，身反不恶寒，其人面色赤…通脉四逆汤主之”，属下列哪一种治法
A. 寒者热之
B. 热者寒之
C. 寒因寒用
D. 热因热用
E. 通因通用

正确答案：D。热因热用

解析：热因热用适用于真寒假热证，即阴寒内盛，格阳于外，形成里真寒外假热的病证（D对）。寒者热之即以热治寒，指用温热方药或具有温热功效的措施而治疗寒性病证的治法。如表寒证用辛温解表方药，里寒证用辛热温里方药（A错）。热者寒之即以寒治热，指用寒凉方药或具有寒凉功效的措施而治疗热性病证的治法。如表热证用辛凉解表方药，里热证用苦寒清里方药等（B错）。寒因寒用即以寒治寒，是指用寒凉方药或具有寒凉功效的措施来治疗具有假寒征象的治法，适用于里热炽盛，阳盛格阴的真热假寒证（C错）。通因通用即以通治通，是指用通利方药或具有通利功效的措施来治疗具有通泻症状的治法，例如如食滞泄泻，由于食滞内停，阻滞胃肠，致腹痛泄泻，泻下物臭如败卵，治疗不仅不能止泄，相反应消食导滞攻下，推荡积滞，使食积去而泄自止（E错）。